阿托品临床可用于
A. 抗休克
B. 抑制腺体分泌
C. 解除平滑肌痉挛
D. 解救有机磷酸酯类中毒
E. 以上说法均正确

正确答案：E。以上说法均正确

解析：阿托品临床可用于：①解除平滑肌痉挛；②抑制腺体分泌③抗休克；④解救有机磷酸酯类中毒；④眼科。掌握“阿托品”知识点。